关于提高社区服务水平不正确的是
A. 努力实现发展社区卫生服务，应对老龄化、城市化的战略举措
B. 承担医疗任务，负责预防保健工作
C. 改善社区的医疗卫生条件，为老、弱、病、残、少儿妇女的保健尽职尽责
D. 改革城市卫生服务体系，积极发展高端医疗卫生服务决策
E. 加强城市社区卫生人才队伍建设

正确答案：D。改革城市卫生服务体系，积极发展高端医疗卫生服务决策